用于胆汁酸的含量测定的反应是
A. Gregory-Pascoe反应
B. Pettenkofer反应
C. Hammarsten反应
D. Millon反应
E. Dansvl反应

正确答案：A。Gregory-Pascoe反应

解析：本题考查的是胆汁酸的鉴别。用于胆汁酸的含量测定的反应是Gregory-Pascoe反应（A对）。胆汁酸的鉴别：1.Pettenkofer反应（B错）：该反应是根据蔗糖在浓硫酸作用下生成羟甲基糠醛，后者与胆汁酸缩合生成紫色物质的原理而进行的，所有的胆汁酸皆呈阳性反应。2.Gregory-Pascoe反应：该反应可用于胆酸的含量测定。3.Hammarsten（C错）反应：胆酸显紫色，鹅去氧胆酸不显色。改良的Hammarsten反应胆酸显紫色。去氧胆酸和鹅去氧胆酸无上述颜色变化。Millon反应（D错）和Dansvl反应（E错），2022年考试指南未明确说明。